深龋备洞时，下列哪项措施是错误的
A. 洞底平，侧壁平直，两者相垂直
B. 去尽腐质
C. 保护牙髓
D. 洞缘线圆钝
E. 尽量保留健康牙体组织

正确答案：A。洞底平，侧壁平直，两者相垂直

解析：本题考查窝洞预备的基本原则。窝洞盒状洞形要求洞底平，侧壁平直，两者相垂直，但深龋追求洞底平容易导致穿髓，因此深龋可以不要求洞底平，以保护牙髓（A错，为本题的正确答案）。对于深龋，龋坏范围一般较深，因此在备洞时，以去尽腐质（B对）为最主要的原则，故洞底平并非必须，需视具体情况而定。去尽腐质，可避免发生继发龋。备洞过程中应注意保护牙髓，减少对牙髓的刺激（C对）。洞缘线圆钝，避免应力集中（D对）。备洞时要尽量保留健康的牙体组织（E对），尽量不做预防性扩展，以保证牙齿的抗力。